乌头碱具有
A. 水溶性
B. 很强的毒性
C. 明显的治疗艾滋病作用
D. 解痉镇痛作用
E. 镇咳作用

正确答案：B。很强的毒性

解析：本题考查的是川乌生物碱在临床应用中应注意的问题。乌头碱具有很强的毒性（B对）。川乌生物碱在临床应用中应注意的问题：由于乌头碱类化合物有剧毒，用之不当易致中毒，且毒性较强，0.2mg即可中毒，2～4mg即可致人死亡。其药物引起的不良反应主要涉及神经系统及心血管系统，临床应用时需注意。此外，乌头不宜与半夏、瓜蒌、贝母、白蔹、白及等同用，临床配伍时应注意。具有水溶性（A错）的为亲水性生物碱。主要有氧化苦参碱、麻黄碱、烟碱、秋水仙碱、咖啡碱等。具有解痉镇痛作用（D错）的是莨菪碱。莨菪碱及其外消旋体阿托品有解痉镇痛、解有机磷中毒和散瞳作用。具有镇咳作用（E错）的是麻黄碱。麻黄水煎液、麻黄醇提取物、麻黄生物碱、麻黄碱均具有平喘、镇咳作用。具有明显的治疗艾滋病作用（C错）的生物碱，2022年考试指南未明确说明。